出现大便隐血试验阳性，其上消化道出血量至少达到的数量是
A. 5mL
B. 10mL
C. 20mL
D. 50mL
E. 60mL

正确答案：A。5mL

解析：呕血及便血量是评价上消化道大出血出血量的重要指标。当出现大便隐血试验阳性，则提示上消化道出血量至少达到5mL（A对）。消化道出血量达60mL时可出现黑便（E错）。